生产、销售以婴幼儿为主要使用对象的劣药者，执法部门对其
A. 处以警告，或者并处五千元以下罚款
B. 处以警告，或者并处一万元以下罚款
C. 处以警告，并处二万元以下罚款
D. 处以正品价格五倍罚款
E. 从重给予行政处罚

正确答案：E。从重给予行政处罚

解析：本题考查从重处罚。生产、销售以婴幼儿为主要使用对象的劣药者，执法部门对其从重给予行政处罚（E对）。根据《药品管理法》第一百三十七条规定，生产、销售劣药，有下列行为之一的，由药品监督管理部门在《药品管理法》和《药品管理法实施条例》规定的处罚幅度内从重处罚：①生产、销售以孕产妇、儿童为主要使用对象的劣药；②生产、销售的生物制品属于劣药；③生产、销售劣药，造成人身伤害后果；④生产、销售劣药，经处理后再犯；⑤拒绝、逃避监督检查，伪造、销毁、隐匿有关证据材料，或者擅自动用查封、扣押物品。